麻疹合并肺炎时应隔离至出疹后
A. 5天
B. 21天
C. 7天
D. 10天
E. 14天

正确答案：D。10天

解析：麻疹合并肺炎者应隔离至出疹后10天（D对），采取这样的措施可以更好的控制传染源，从而减少传染病的发病率。